下列不能用于计数肋骨和椎骨的结构是
A. 隆椎棘突
B. 肋弓
C. 胸骨角
D. 肩胛骨下角
E. 上述结构都不可以

正确答案：B。肋弓

解析：第 8 -10 对肋肋前端借肋软骨与上位肋软骨连结，形成肋弓，不用于计数肋骨和椎骨（B错，为本题正确答案）。第 7 颈椎又名隆椎，常作为计数椎骨序数的标志（A对）。胸骨角可在体表扪及，两侧平对第 2 肋，是计数肋的重要标志（C对）。下角为脊柱缘与腋缘会合处，平对第 7 肋或第 7 肋间隙，为计数肋的标志（D对）。